属于脂质体质量要求的控制项目有
A. 形态、粒径及其分布
B. 包封率
C. 载药量
D. 稳定性
E. 磷脂与胆固醇比例

正确答案：A、B、C、D。形态、粒径及其分布；包封率；载药量；稳定性

解析：本题考查脂质体的质量要求。脂质体质量要求的控制项目有：（1）形态、粒径及其分布（A对）；（2）包封率（B对）；（3）载药量（C对）；（4）脂质体的稳定性（D对），包括化学稳定性与物理稳定性。脂质体的质量要求中没有对磷脂与胆固醇比例（E错）的要求。